以下哪一项属于皮脂腺囊肿所特有的表现
A. 常见于面部
B. 发生缓慢
C. 囊壁与皮肤粘连，中央可有一色素点
D. 质地软，无压痛
E. 边界清楚，可活动

正确答案：C。囊壁与皮肤粘连，中央可有一色素点

解析：常见于面部，小的如豆，大则可至小柑橘样。囊肿位于皮内，并向皮肤表面突出。囊壁与皮肤紧密粘连，中央可有一“色素点”。临床上可以根据这个主要特征与表皮样囊肿作鉴别。掌握“皮脂腺、皮样或表皮样囊肿”知识点。